引起恶性疟疾发作不规则的主要原因是
A. 恶性疟原虫侵犯各期红细胞
B. 潜伏在肝脏中的裂殖子侵犯红细胞
C. 恶性疟原虫在红细胞内发育时间不一致
D. 粘附在血管内的疟原虫再度侵犯新的红细胞
E. 疟原虫释放毒素

正确答案：C。恶性疟原虫在红细胞内发育时间不一致

解析：疟原虫在红细胞内发育时一般无症状，红细胞破裂后，释放出裂殖子及其代谢产物，一部分被单核-吞噬细胞系统吞噬而消灭，一部分侵入新的红细胞，继续发育、繁殖，且发育时间不一（C对），故发作不规则。恶性疟原虫侵犯各期红细胞（A错），且繁殖周期短，将导致更严重的临床症状和贫血。潜伏在肝脏中的裂殖子（B错）会致复发（P283）。粘附在血管内的疟原虫（D错）会致再燃（P283）。疟原虫释放毒素（E错）会致黑尿热（P283）。